LD₅₀的概念是
A. 引起半数动物死亡的最大剂量
B. 引起半数动物死亡的最小剂量
C. 出现半数动物死亡的该试验组的剂量
D. 能引起一群动物50%死亡的剂量（统计值）

正确答案：D。能引起一群动物50%死亡的剂量（统计值）

解析：本题考查LD₅₀。LD₅₀是指能引起一群动物50%死亡的剂量（统计值）（D对ABC错）。